依据2002年9月1日实施的《医疗事故处理条例》，不属于医疗事故的是
A. 医疗机构违反规章造成患者重度残废
B. 在医疗活动中，由于患者病情异常而发生医疗意外
C. 医务人员违反诊疗常规，造成患者一般功能性障碍
D. 医务人员违反护理常规，造成患者轻度残废
E. 药房等非临床科室因过失导致患者人身损害

正确答案：B。在医疗活动中，由于患者病情异常而发生医疗意外

解析：依据2002年9月1日实施的《医疗事故处理条例》，不属于医疗事故的是在医疗活动中，由于患者病情异常而发生医疗意外（B对）。